治疗抽动障碍脾虚痰聚证，应首选的方剂是
A. 逍遥散
B. 泻青丸
C. 十味温胆汤
D. 龙胆泻肝汤
E. 柴胡疏肝散

正确答案：C。十味温胆汤

解析：小儿抽动障碍脾虚痰聚证的病机为脾虚不运，水湿潴留，聚液成痰；脾主肌肉四肢，脾虚则肝旺，肝风挟痰上扰走窜则发头项、四肢、肌肉抽动，故当治以健脾化痰，平肝熄风，用十味温胆汤加减（C对），方中党参、茯苓健脾助运；陈皮、半夏燥湿化痰，枳实顺气消痰，远志、枣仁化痰宁心；钩藤、白芍、石决明平肝息风；甘草调和诸药，诸药合用，共同发挥健脾化痰，平肝熄风之效。逍遥散功用为疏肝解郁，健脾养血（A错）。泻青丸功用为清肝泻火（B错）。龙胆泻肝汤功用为清泄肝胆实火，清利肝胆湿热（D错）。柴胡疏肝散功用为疏肝行气，活血止痛（E错）。